属于控释制剂的是
A. 阿奇霉素分散片
B. 硫酸沙丁胺醇口崩片
C. 硫酸特布他林气雾剂
D. 复方丹参滴丸
E. 硝苯地平渗透泵片

正确答案：E。硝苯地平渗透泵片

解析：本题考查控释制剂。硝苯地平渗透泵片（E对）为控释制剂。分散片（A错）、口崩片（B错）、气雾剂（C错）、滴丸（D错）均为快速释放制剂。